患儿，4岁。发热1天，全身出现红色斑丘疹，继有疱疹，头面躯干多见，舌红苔薄白，脉浮数。应首先考虑的诊断是
A. 风疹
B. 猩红热
C. 幼儿急疹
D. 麻疹
E. 水痘

正确答案：E。水痘

解析：水痘为小儿常见急性出疹性传染病，临床特征为发热，皮肤黏膜分批出现的瘙痒性斑、丘、疱疹及结痂，且上述各期皮疹可同时存在。初为红斑疹，数小时后变为深红色丘疹，再经数小时发展为疱疹。本病例皮疹特点符合水痘早期临床表现，故诊断为水痘（E对）。风疹（A错）临床以发热，皮疹及耳后、枕后、颈部淋巴结肿大为特征，其皮疹特点为多数病人发热1～2天后出疹，皮疹多为散在淡红色斑丘疹。猩红热（B错）是其皮疹特点为皮疹于发热第2天迅速出现，最初见于腋下、颈部与腹股沟，24小时内迅速蔓延至全身；疹间皮肤潮红，用手压可暂时苍白，去压后红疹又出现；口鼻周围皮肤苍白，形成口周苍白圈；皮肤皱折处，形成深红色横纹线，称"帕氏线"。幼儿急疹（C错）典型临床表现是：发热持续3～5天，体温多达39℃或更高，但全身症状较轻；热退后出疹，皮疹为红色斑丘疹，迅速遍布于躯干及面部，2～3天皮疹消失，无色素沉着及脱屑。麻疹（D错）其皮疹特点为在发热3～4天左右开始出疹，先见于耳后、颈部，24小时内波及面部、躯干及上肢，于第3天皮疹累及下肢及足部；皮疹初起为玫瑰红色斑丘疹，大小不等，稀疏分明，继而疹色加深，呈暗红色，疹间可见正常皮肤，病情严重者皮疹常融合。